与深龋临床表现不符合的是
A. 洞底深、接近髓腔
B. 食物嵌入痛
C. 偶在夜间隐痛
D. 酸甜刺激敏感
E. 牙髓活力测试正常

正确答案：C。偶在夜间隐痛

解析：本题考查深龋的临床表现。偶在夜间隐痛是牙髓炎的表现，深龋时无夜间痛表现（C错，为本题的正确答案）。龋病进展到牙本质深层时为深龋，临床上可见到洞底深、接近髓腔的龋洞（A对）。表现为食物嵌入痛（B对）、冷热、酸甜刺激敏感（D对），刺激去除后缓解、牙髓活力测试正常（E对），与邻牙测试反应一致。